按《中国药典》规定，芦荟质量控制成分为芦荟苷，其结构类型属于
A. 有机酸类
B. 蒽醌类
C. 生物碱类
D. 黄酮类
E. 香豆素类

正确答案：B。蒽醌类

解析：本题考查的是芦荟的化学成分。按《中国药典》规定，芦荟质量控制成分为芦荟苷，其结构类型属于蒽醌类（B对）。芦荟中主要活性成分是羟基蒽醌类衍生物，包括芦荟大黄素、大黄酸、大黄素、大黄酚、大黄素甲醚等。《中国药典》以芦荟苷为指标成分进行含量测定，芦荟苷含量不得少于16.0%。有机酸类（A错）广泛存在于植物界中，很多中药的活性成分为有机酸，如鸦胆子中的油酸、地龙中的丁二酸，巴豆中的巴豆油酸，丹参中的乳酸等。生物碱类（C错）主要分布于植物界，在动物界中少有发现。生物碱绝大多数存在于双子叶植物中，已知有50多个科的120多个属中存在生物碱。与中药有关的典型的科有毛茛科（黄连属黄连，乌头属乌头、附子）、防己科（汉防己、北豆根）、罂粟科（罂粟、延胡索）、茄科（曼陀罗属洋金花、颠茄属颠茄、莨菪属莨菪）、马钱科（马钱子）、小檗科（三颗针）、豆科（苦参属苦参、槐属苦豆子）等。单子叶植物也有少数科属存在生物碱，如石蒜科、百合科（贝母属的川贝母、浙贝母）、兰科等。少数裸子植物如麻黄科、红豆杉科、三尖杉科和松柏科也存在生物碱。低等植物中仅发现极个别的存在生物碱，如烟碱存在于蕨类植物中，麦角生物碱存在于菌类植物中。地衣、苔藓类植物中仅发现少数简单的吲哚类生物碱。藻类、水生类植物中未发现生物碱。黄酮类（D错）化合物广泛存在于自然界中，多存在于高等植物及羊齿类植物中。苔类中含有的黄酮类化合物为数不多，而藻类、霉菌、细菌中没有发现黄酮类化合物。香豆素类（E错）广泛存在于高等植物中，尤其以芸香科和伞形科为多见。